男孩，4岁。发热2天，皮疹1天，伴咽部疼痛。查体：T39.2℃，全身皮肤弥漫性充血，伴密集针尖大小丘疹，咽红，扁桃体Ⅱ度肿大，可见少许渗出。血常规：Hb135g/L，WBC12.6×10⁹/L，N0.65，Plt250×10⁹mg/L，CRP15mg/L，最可能的诊断是
A. 幼儿急疹
B. 水痘
C. 猩红热
D. 麻疹
E. 丘疹样荨麻疹

正确答案：C。猩红热

解析：患儿发热，咽痛，发热1～2天后出疹，出疹时高热，皮肤弥漫充血，上有密集针尖大小丘疹（猩红热典型临床表现及体征）。综合患者的临床表现、体征，最可能的诊断是猩红热（C对）。幼儿急疹（A错）多见于婴幼儿期，患儿高热3～5天，期间可伴惊厥；热退疹出，为红色细小密集斑丘疹（P170）。水痘（B错）多见于2～6岁儿童。于发热24～48小时内出现皮疹，皮疹经历由红色斑疹和（或）丘疹变为透明饱满的水疱继而破溃结痂等历程，伴明显瘙痒感。该病可自愈（P175）。麻疹（D错）表现多于发热3～4天后出疹，发热高峰期为出疹期。临床表现为发热、咳嗽、畏光、鼻卡他、结膜炎，Koplik斑等症状（P170）。